4个月的女婴，冬季出生，足月顺产，单纯牛奶喂养，未添加辅食。近半个月来较烦躁，夜间哭闹不安、多汗。体检：体重6kg，有颅骨软化。最可能的诊断是
A. 营养不良
B. 亚临床维生素A缺乏症
C. 维生素D缺乏性佝偻病
D. 婴儿肠痉挛
E. 以上都不是

正确答案：C。维生素D缺乏性佝偻病

解析：本题考查维生素D缺乏性佝偻病病例分析。4个月女婴，冬季出生，日照不足，单纯牛奶喂养且未及时添加辅食，说明存在维生素入量不足。主要症状烦躁、夜间哭闹不安、多汗、有颅骨软化是佝偻病初期特点。最可能的诊断是维生素D缺乏性佝偻病（C对ABDE错）。